造成军团病发病的主要原因是
A. 室内装饰材料释放有机污染物
B. 饮用水重金属污染
C. 室内吸烟且通风不良
D. 室内燃煤
E. 空调系统带菌

正确答案：E。空调系统带菌

解析：本题考查军团病发病的主要原因。军团病是一种由军团菌引起的呼吸道感染疾病，所以造成军团病发病的主要原因是空调系统带菌（E对ABCD错）。军团菌是一种细菌，在空调系统中可以繁殖，当它们进入空气中时，就可能通过呼吸道进入人体，从而引起军团病。